人类免疫缺陷病毒（HIV）在人体内作用的靶细胞是
A. CD4+T淋巴细胞
B. CD8+T淋巴细胞
C. 淋巴细胞
D. NK细胞
E. CTL细胞

正确答案：A。CD4+T淋巴细胞

解析：获得性免疫缺陷综合症（艾滋病）是由人类免疫缺陷病毒（HIV）感染引起的继发性免疫缺陷病，人类免疫缺陷病毒（HIV）在人体内作用的靶细胞是CD4+T淋巴细胞（A对），当HIV进入人体后，嵌于病毒包膜上的gp120与CD4+T细胞上CD4+受体相结合，同时在共受体的帮助下进入细胞，CD4+T细胞在HIV的直接和间接作用下，细胞功能受损、大量被破坏，导致细胞免疫缺陷而发病。CD8+T淋巴细胞（B错）是T杀伤/抑制细胞。B淋巴细胞（C错）主要参与体液免疫，而艾滋病主要与细胞免疫有关。NK细胞（D错）是指自然杀伤细胞。CTL细胞（E错）细胞毒性T淋巴细胞，亦叫TC细胞，是白细胞的亚部，为一种特异T细胞，分泌各种细胞因子参与免疫作用，对某些病毒、肿瘤细胞等抗原物质具有杀伤作用，与自然杀伤细胞构成机体抗病毒、抗肿瘤免疫的重要防线。